男，75岁。间断上腹痛20年。加重伴黑便1个月。查体：T36.5°C，P90次/分，BP120/80mmHg。消瘦，全身浅表淋巴结未触及。上腹部深压痛，无肌紧张、反跳痛。血常规：Hb85g/L，WBC8.6×10⁹/L，PLT120×10⁹/L。胃镜检查示胃窦4cm×3cm溃疡型胃癌，超声内镜检查示肿瘤浸润至固有肌层。腹部CT提示幽门上、下淋巴结肿大。该患者所疾病的临床TNM分期是
A. T₁N₁M₀
B. T₃N₂M₁
C. T₃N₂M₀
D. T₂N₂M₀
E. T₂N₁M₀

正确答案：E。T₂N₁M₀

解析：患者肿瘤浸润至固有肌层，为T₂。幽门上、下淋巴结肿大，为N₁。无远处转移，为M₀。因此该病人胃癌的临床TNM分期是T₂N₁M₀（E对）。